公共场所中也可能存在放射性污染，长期接触高浓度的氡及子体可以引发
A. 肝癌
B. 肺癌
C. 哮喘
D. 膀胱癌
E. 肺结核

正确答案：B。肺癌

解析：本题考查长期接触高浓度的氡及子体可以引发的疾病。公共场所中也可能存在放射性污染如氡及其子体，主要来源于建筑物的地基和建筑材料，长期接触高浓度的氡及其子体可以引起肺癌（B对ACDE错）。